关于异丙肾上腺素的药理作用，说法错误的是
A. 对于心脏能够表现出正性肌力和正性频率作用
B. 可以使骨骼肌血管舒张
C. 可以舒张支气管平滑肌
D. 能够增加糖原分解，增加组织耗氧量
E. 中枢兴奋作用明显

正确答案：E。中枢兴奋作用明显

解析：异丙肾上腺素的药理作用为：①对心脏β1受体具有强大的激动作用，表现为正性肌力与正性频率作用；②主要激动β2受体使骨骼肌血管舒张，增加血流量；③可激动支气管β2受体，舒张支气管平滑肌；④增加糖原分的分解，增加组织耗氧量，且不易透过血脑屏障，中枢兴奋作用不明显。掌握“多巴胺和异丙肾上腺素”知识点。